念珠菌阴道炎的治疗，错误的是
A. 积极治疗糖尿病
B. 用4％碳酸氢钠液冲洗阴道
C. 克霉唑栓剂放置阴道
D. 甲硝唑栓剂放置阴道
E. 1％龙胆紫液涂擦阴道

正确答案：E。1％龙胆紫液涂擦阴道

解析：念珠菌炎也称外阴阴道假丝酵母菌病。念珠菌（假丝酵母菌）在pH5.5～6.5环境下最适宜生长繁殖（第2版实用妇产科学P556），用4%碳酸氢钠液冲洗阴道（B对），改变阴道酸碱度可抑制念珠菌的生长。念珠菌阴道炎主要以局部短疗程抗真菌药为主，可选用克霉唑栓剂（C对）或甲硝唑栓剂放置阴道（D对），若合并糖尿病，应积极治疗糖尿病（A对）。1%龙胆紫液涂擦阴道（E错，为本题正确答案）后容易结痂，且常有痂下积脓感染，该方法现已弃用。